根据2015年版《中国药典》“凡例”[贮藏]项下对药品贮藏与保管基本要求的规定。阴凉处的温度应控制在
A. 2～10℃
B. 10～25℃
C. 2～5℃
D. 不超过20℃
E. 10～30℃

正确答案：D。不超过20℃

解析：本题考查的是《中国药典》“凡例”［贮藏］项下对各名词术语的规定。根据2015年版《中国药典》“凡例”[贮藏]项下对药品贮藏与保管基本要求的规定。阴凉处的温度应控制在不超过20℃（D对）。《中华人民共和国药典》简称《中国药典》，是国家监督管理药品质量的法定技术标准。在《中国药典》“凡例”中，对中药［贮藏］项下的各名词术语进行了详细的解释。［贮藏］项下的规定，系对药品贮藏与保管的基本要求，除矿物药应置干燥洁净处不作具体规定外，一般以下列名词术语表示。（1）遮光：系指用不透光的容器包装，例如棕色容器或黑色包装材料包裹的无色透明、半透明容器。（2）密闭：系指将容器密闭，以防止尘土及异物进入。（3）密封：系指将容器密封，以防止风化、吸潮、挥发或异物进入。（4）熔封或严封：系指将容器熔封或用适宜的材料严封，以防止空气和水分的侵入并防止污染。（5）阴凉处：系指不超过20℃的环境。（6）凉暗处：系指避光并不超过20℃的环境。（7）冷处：系指2～10℃（A错）的环境。（8）常温：系指10～30℃（E错）的环境。除另有规定外，［贮藏］项未规定贮存温度的一般系指常温。